药品监督管理部门经监督抽验发现，某医院使用的人血白蛋白注射液中的白蛋白含量仅为0.02%（g/ml），根据《中华人民共和国药品管理法》应
A. 追究该医院法定代表人的责任
B. 追究负责供应该药品的药品批发企业的责任
C. 直接追究该药品生产企业的责任
D. 分别追究涉案药品生产、经营企业以及该医院的责任
E. 按照一事不再罚原则，只追究相关直接责任人员的责任

正确答案：D。分别追究涉案药品生产、经营企业以及该医院的责任

解析：本题考查违反药品管理法的法律责任。药品监督管理部门经监督抽验发现，某医院使用的人血白蛋白注射液中的白蛋白含量仅为0.02%（g/ml），根据《中华人民共和国药品管理法》应分别追究涉案药品生产、经营企业以及该医院的责任（D对）。《中华人民共和国药品管理法》第一百一十八条规定，生产、销售假药，或者生产、销售劣药且情节严重的，对法定代表人、主要负责人、直接负责的主管人员和其他责任人员，没收违法行为发生期间自本单位所获收入，并处所获收入百分之三十以上三倍以下的罚款，终身禁止从事药品生产经营活动，并可以由公安机关处五日以上十五日以下的拘留。